用作液体药剂的防腐剂是
A. 羟苯酯类
B. 阿拉伯胶
C. 阿司帕坦
D. 胡萝卜素
E. 氯化钠

正确答案：A。羟苯酯类

解析：本题考查液体制剂常用的附加剂。羟苯酯类（A对）为液体制剂中常用的防腐添加剂，有甲、乙、丙、丁四种酯，无毒、无臭，抑菌作用较强；阿拉伯胶（B错）主要作为可以食用的稳定剂、乳化剂、增黏剂和赋形剂；阿司帕坦（C错）是一种非碳水化合物类的人造甜味剂；胡萝卜素（D错）是食用油溶性色素，可作为药物的着色剂；氯化钠（E错）为液体制剂制备中常用的渗透压调节剂。